既息风平肝，又祛风通络的药是
A. 礞石
B. 天麻
C. 钩藤
D. 全蝎
E. 石决明

正确答案：B。天麻

解析：本题考查的是天麻的功效。既息风平肝，又祛风通络的药是天麻（B对）。天麻：【功效】息风止痉，平抑肝阳，祛风通络。礞石（A错）：【功效】消痰下气，平肝镇惊。钩藤（C错）：【功效】息风止痉，清热平肝。全蝎（D错）：【功效】息风止痉，攻毒散结，通络止痛。石决明（E错）：【功效】平肝潜阳，清肝明目。